苯甲酸钠和葡萄糖的CRH值分别为88%和82%，根据Elder假说，CRH值约为
A. 0.66
B. 0.72
C. 0.78
D. 0.84
E. 0.9

正确答案：B。0.72

解析：本题考查CRH的计算。混合物的CRH约等于各药物CRH的乘积，与各组分的比例无关，故混合后CRH（%）=88%×82%=72%（B对）。